患者，女，26岁。近1个月来出现失眠，难以入睡。食欲较差，体重减轻2kg。自觉无能、没用、孤独、没有人关心自己，对未来也不抱任何希望，偶尔出现生不如死的想法。目前患者存在的突出症状是
A. 三自症状
B. 思维迟缓
C. 睡眠障碍
D. 消极观念
E. 三无症状

正确答案：E。三无症状